女，30岁。妊娠36周，心悸气短3天，无咽痛、咳嗽等不适。既往体健。查体：BP120/73mmHg，心界明显扩大，心律不齐，频发早搏。心脏超声：心脏扩大，左室、左房为著，室壁运动减弱，射血分数34%。最可能的诊断是
A. 风湿性心脏病
B. 妊娠期高血压心脏病
C. 先天性心脏病
D. 围产期心肌病
E. 病毒性心肌炎

正确答案：D。围产期心肌病

解析：妊娠晚期妇女，既往体健，心悸气短，心界扩大，心律失常，超声心动图显示心腔扩大，以左室、左房大为主，室壁运动普遍减弱，射血分数减少。最可能的诊断是围产期心肌病（D对）。风湿性心脏病（A错）为溶血性链球菌感染咽部，并反复发作所致的心脏损害，常累及二尖瓣、主动脉瓣等造成二尖瓣、主动脉瓣狭窄和（或）关闭不全，可伴环形红斑，皮下结节，舞蹈病等结外表现。患者血压正常，可排除妊娠期高血压心脏病（B错）。先天性心脏病（C错）指出生时即存在心脏和大血管结构异常的心脏病。病毒性心肌炎（E错）多数病人发病前1～3周有病毒感染前驱症状，如发热、全身倦怠感和肌肉酸痛，或恶心、呕吐等消化道症状。随后可以有心悸、胸痛、呼吸困难、水肿，甚至晕厥、猝死，严重程度视病变范围及部位而定。